在胃酸中稳定且无味的抗生素是
A. 红霉素
B. 琥乙红霉素
C. 克拉霉素
D. 阿奇霉素
E. 罗红霉素

正确答案：B。琥乙红霉素

解析：本题考查抗生素。琥乙红霉素（B对）为红霉素的乙酰琥珀酸酯，在胃酸中稳定且无味。红霉素（A错）在胃酸中不稳定，易被破坏。克拉霉素（C错）是对红霉素C-6位羟基甲基化后得到的衍生物，使红霉素C-9羰基无法形成半缩酮而增加其在酸中的稳定性，味苦。阿奇霉素（D错）是将红霉素肟经贝克曼重排得到的扩环产物，对胃酸稳定，味苦。罗红霉素（E错）是将红霉素C-9的羰基进行修饰，对胃酸稳定，口服吸收迅速，在肺组织中浓度较高，味苦。